从赤霉病麦中分离的主要菌种是
A. 串珠镰刀菌
B. 禾谷镰刀菌
C. 木贼镰刀菌
D. 黄色镰刀菌
E. 尖孢镰刀菌

正确答案：B。禾谷镰刀菌